患者，男性，70岁，间断排尿困难1个月入院，B超检查见前列腺增大，血清总PSA24ng/ml，为明确诊断，最可靠的检查方法是
A. 经直肠腔内超声
B. 前列腺MRI
C. 前列腺CT
D. 前列腺穿刺活检
E. 直肠指诊

正确答案：D。前列腺穿刺活检